50例胃癌患者随机分为两组分别接受两种化疗方案的治疗，随访得到患者的生存资料如下所示（⁺代表删失数据）：甲组：3、8⁺、6、11、20、15、16⁺17、8、7⁺、9、10、15、18⁺、19、25、18、16、15、14⁺16、11、9、13⁺、12。乙组：10⁺6、9、10、15、11⁺、12、7、9、17、9⁺16、19⁺、22、23、25、16、18、17、16、19、16、11⁺、15、17。以下合适的统计描述和假设检验方法分别为
A. 寿命表法和log-rank检验
B. 寿命表法和卡方检验
C. Kaplan-Meier法和卡方检验
D. Kaplan-Meier法和log-rank检验
E. Kaplan-Meier法和寿命表法

正确答案：D。Kaplan-Meier法和log-rank检验

解析：本题考查对生存资料进行统计描述和假设检验方法。对生存资料进行统计描述和假设检验方法为Kaplan-Meier法和log-rank 检验（D对ABCE错）。